下列慢性颅内压增高所引起头颅X线改变，错误的是
A. 指状压迹增多加深
B. 颅缝增宽
C. 蛛网膜粒压迹扩大增深
D. 枕大孔扩大
E. 蝶鞍扩大，前后床突及鞍背的骨质吸收

正确答案：D。枕大孔扩大

解析：慢性颅内压增高多见于生长缓慢的良性肿瘤（如垂体腺瘤）、慢性硬膜下血肿等。颅内压增高可使颅骨骨缝增宽、分离（B对）；肿瘤周围脑组织水肿，可使颅骨内面的脑回指状压迹增多、加深（A对）；蛛网膜颗粒压迹是蛛网膜粒在颅骨内板上引起的压迹，颅内压增高时压迫蛛网膜粒，使蛛网膜粒压迹扩大、增深（C对）；垂体腺瘤可使蝶鞍扩大，前后床突及鞍背的骨质吸收（E对）。以上表现在头颅X线平片上均可观察到。颅内压增高不会引起枕骨大孔扩大，因此，头颅X线片不会出现枕骨大孔扩大（D错，为本题正确答案）的改变。